沙眼宜选择
A. 酞丁安
B. 双氯芬酸
C. 益康唑
D. 羟苄唑
E. 泼尼松

正确答案：A。酞丁安

解析：本题考查沙眼治疗药。酞丁安（A对）为抗菌药，对沙眼衣原体有强大的抑制作用，在沙眼包涵体尚未形成时，能阻止沙眼衣原体的繁殖和包涵体的形成，尤其对轻度沙眼疗效最好。双氯芬酸（B错）属于非甾体抗炎药，具有抗炎、镇痛及解热作用。用于风湿性关节炎、非炎性关节痛、关节炎、非关节性风湿病、非关节性炎症引起的疼痛，各种神经痛、癌症疼痛、创伤后疼痛及各种炎症所致发热等。益康唑（C错）为咪唑类抗真菌药，主要用于皮肤或黏膜感染，治疗皮肤癣病，如股癣、手足癣及念珠菌阴道炎等。羟苄唑（D错）是抗病毒药，用于过敏性结膜炎。泼尼松（E错）是糖皮质激素，用于流行性出血性结膜炎。